《处方管理办法》规定，药学专业技术人员调剂处方时必须做到“四查十对”，对科别、姓名、年龄属于
A. 查处方
B. 查药品
C. 査配伍禁忌
D. 査用药合理性
E. 查医生的签名

正确答案：A。查处方

解析：本题考查的是“四查十对”原则。《处方管理办法》规定，药学专业技术人员调剂处方时必须做到“四查十对”，对科别、姓名、年龄属于查处方（A对）。“四查十对”原则：药师调剂处方时必须做到“四查十对”：查处方，对科别、姓名、年龄；查药品（B错），对药名、剂型、规格、数量；查配伍禁忌（C错），对药品性状、用法用量；查用药合理性（D错），对临床诊断。